与阿替普酶相比，对纤维蛋白特异性更好，血浆消除半衰期更长，尤其适用于心肌梗死入院前在救护车上给药的溶栓药是
A. 尿激酶
B. 链激酶
C. 肌酸激酶
D. 瑞替普酶
E. 替奈普酶

正确答案：E。替奈普酶

解析：本题考查替奈普酶的治疗效果。替奈普酶（E对）比阿替普酶具有更好的纤维蛋白特异性，TNK-tPA注射30～50mg后的第一个6小时内，全身纤维蛋白原和纤溶酶原水平仅下降5%～15%。